女，24岁。停经45天，诊断为早期妊娠。在行负压吸宫术时，突然出现面色苍白、出汗、头晕、胸闷，体检血压80/50mmHg，心率40次/分。恰当的处理是
A. 超声监护下继续人工流产操作
B. 静脉注射阿托品0.5mg
C. 改行钳刮术
D. 肌内注射缩宫素20单位
E. 立即行剖腹探査

正确答案：B。静脉注射阿托品0.5mg

解析：患者为育龄期妇女，诊断为早期妊娠，行人工流产负压吸宫术时突然出现面色、苍白、出汗、头晕、胸闷，低血压，心动过缓（人工流产综合反应指受术者在术中或术毕出现恶心呕吐、心动过缓、心律不齐、面色苍白、头昏、胸闷、大汗淋漓，严重者甚至出现血压下降、昏厥、抽搐等迷走神经兴奋症状），最可能的诊断是人工流产综合征。对于人工流产综合反应，发现症状应立即停止手术（ACE错），给予吸氧，一般能自行恢复。该患者病情严重，最合适的处理是静脉注射阿托品0.5mg（B对）。肌内注射催产素20U（P383）（D错）用于人工流产术中出血的患者，使子宫收缩止血。